下列各项，具有回阳救逆作用的是
A. 气海、膻中
B. 神阙、关元
C. 中脘、足三里
D. 气海、合谷
E. 大椎、关元

正确答案：B。神阙、关元

解析：神阙穴为任脉的要穴，具有回阳固脱、益下元、调肠胃作用。关元穴是任脉常用的重要腧穴有培元固本、补益下焦作用，临床应用时神阙一般须长时间用灸法，二穴配合是治疗回阳救逆的最佳选择（B对）。气海具有增强元气，总调下焦气机的作用，膻中调上焦之气，具有宣肺、宽胸、降逆的作用（A错）。中脘重在和胃理气，在健脾和胃、益气消积的同时，主要调理肝胆脾胃气机不利，足三里穴不仅能够疏经通络、祛风除湿，还可以健脾和胃、益气生血，具有很好的防病保健的作用（C错）。合谷能宣泄气中之热,具有升清降浊,疏风散表,宣通气血的作用（D错）。诸症大椎为诸阳之会，针灸有宣导阳气、消散瘀热的作用（E错）。